下列各项可用于鉴别白色水肿与白斑，除了
A. 白色水肿质地柔软
B. 白色水肿边界不清
C. 白色水肿表面光滑
D. 白色水肿无上皮角化
E. 白色水肿棘层细胞肿胀

正确答案：D。白色水肿无上皮角化

解析：本题考查白色水肿与白斑的鉴别。白色水肿见于双颊黏膜咬合线附近，为灰白色或乳白色半透明斑膜，为上皮角化形成（D错，为本题的正确答案），边界不清（B对），颇似白斑，但较白斑软（A对），扪之表面柔软光滑（C对），无压痛。而白斑边界清晰，触诊表面质地较硬，且有粗糙感或皮损。组织病理学检查白色水肿可见上皮增厚，上皮细胞内水肿，棘层细胞肿胀（E对）胞核固缩或消失，出现空泡性变。